中医治疗血虚证时，常加入一定量的补气药，其根据是
A. 气能生血
B. 血能生气
C. 血能载气
D. 气能行血
E. 气能摄血

正确答案：A。气能生血

解析：本题考查气与血的关系，属于理解记忆内容。气能生血，是指血液的化生离不开气作为动力。血液的化生以营气、津液和肾精作为物质基础，在这些物质本身的生成以及转化为血液的过程中，每一个环节都离不开相应脏腑之气的推动和激发作用，这是血液生成的动力。气能生血还包含了营气在血液生成中的作用，营气与津液入脉化血，使血量充足。因此，气的充盛则化生血液的功能增强，血液充足；气的虚亏则化生血液的功能减弱，易于导致血虚的病变，故中医治疗血虚证时，常加入一定量的补气药（A对）。